聚维酮碘用于阴道皮肤黏膜消毒的浓度是
A. 5%
B. 0.5%
C. 0.25%
D. 0.025%
E. 0.5%

正确答案：D。0.025%

解析：本题考查聚维酮碘的用法用量。聚维酮碘用于阴道黏膜及伤口黏膜创面消毒时，0.025%（D对）冲洗3～5min。